成人呼吸窘迫综合征（ARDS）的最重要的诊断依据是
A. 呼吸频率增加，每分钟大于28次
B. 肺泡气一动脉血氧分压差[P（A-a）O₂]降低
C. 氧合指数（PaO₂／FiO₂）≤300mmHg
D. 肺内分流量减少
E. 血气分析显示为低氧伴轻度二氧化碳潴留

正确答案：C。氧合指数（PaO₂／FiO₂）≤300mmHg

解析：目前在临床上面诊断成人呼吸窘迫综合征（ARDS）以PaO₂／FiO₂最为常用，PaO₂／FiO₂正常值为400～500mmHg，PaO₂／FiO₂≤300mmHg是诊断ARDS重要的诊断依据（C对）。呼吸频率增加且每分钟大于28次（A错）可为ARDS患者最早出现的症状，但其也可见于哮喘等疾病，也可见于运动后，不具有诊断特异性，故其不是成人呼吸窘迫综合征（ARDS）的最重要的诊断依据。肺泡气一动脉血氧分压差[P（A-a）O₂]降低（B错）、肺内分流量减少（D错）对于ARDS的诊断、严重性分级和疗效评价等均有重要意义，但并不是诊断ARDS必要的条件，故其不作为成人呼吸窘迫综合征（ARDS）的最重要的诊断依据。血气分析显示为低氧伴轻度二氧化碳潴留（E错）多见于ARDS患者发病的后期，对于早期诊断意义有限，并且还可见于重症COPD等疾病，不具有诊断特异性，故其不是成人呼吸窘迫综合征（ARDS）的最重要的诊断依据。